在结构中8位引入甲氧基，增加药物对紫外线的稳定性，降低药物的光毒性，该药物是
A. 环丙沙星
B. 洛美沙星
C. 依诺沙星
D. 莫西沙星
E. 氧氟沙星

正确答案：D。莫西沙星

解析：本题考查喹诺酮类药物的性质和代谢。莫西沙星（D对）8位有甲氧基取代，对革兰阳性菌，革兰阴性菌、厌氧菌、抗酸菌和非典型微生物如支原体、衣原体、军团菌有广谱抗菌活性。